男性矿工，井下作业时发生塌方砸伤背部，当即倒于地上，下肢无力不能行走，立即来诊。检查见胸腰段后凸畸形并压痛，双下肢不全瘫。感觉异常平面位于双侧腹股沟水平。正确的搬运方法是
A. 一人用一手抱颈另一手抱腿放于担架上
B. 一人抬头，另一人抬足放于木板上
C. 两人架其上肢助其走上担架车
D. 两人将其躯干成一体滚动至木板上
E. 三人分别抬其头和两腿放于担架上

正确答案：D。两人将其躯干成一体滚动至木板上

解析：患者背部砸伤后，检查见胸腰段后凸畸形并压痛（提示有脊柱骨折），下肢无力不能行走、双下肢不全瘫、双侧腹股沟水平感觉异常（提示有脊髓损伤），结合患者病史、临床表现及检查，该患者最可能的诊断为胸腰段椎体骨折合并脊髓损伤。对于已有或怀疑有脊髓损伤病人，正确的搬运方法是两人将其躯干成一体滚动至木板上，可避免搬运过程中对患者造成二次损伤，保持脊柱的稳定性（D对）。一人用一手抱颈另手抱腿放于担架上（A错）或一人抬头、另人抬足放于木板上（B错）或两人架其上肢助其走上担架车（C错）及三人分别抬其头和两腿放于担架上（E错）等搬运方法，均会增加脊柱的弯曲，使碎骨片向后挤入椎管内，加重脊髓的损伤。